符号秩和检验中差数总体的中位数为
A. 0
B. 1
C. 2
D. 3
E. 4

正确答案：A。0

解析：符号秩和检验基本思想是：假设两种处理效应相同，则每对变量的差数的总体是以0为中心对称分布的，这时差数总体的中位数为0。掌握“秩和检验、直线回归和线性分析”知识点。